男，26岁。突发剑突下疼痛，6小时后疼痛转移到右下腹，恶心纳差，轻度发热,右下腹有压痛，无反跳痛，舌苔白腻，脉弦滑。宜选用
A. 复方大柴胡汤
B. 阑尾化瘀汤
C. 藿香正气散加减
D. 大承气汤加减
E. 大黄牡丹汤合红藤煎

正确答案：E。大黄牡丹汤合红藤煎

解析：肠痈特点是:转移性右下腹疼痛，伴恶心、呕吐、发热，右下腹局限性压痛，符合患者表现，因此可诊断为肠痈 瘀滞证。复方大柴胡汤适用于肠痈湿热证（A错）。阑尾化瘀汤适用于阑尾炎症消散后（B错）。藿香正气散、大承气汤不适用于肠痈（C、D错）。大黄牡丹汤合红藤煎适用于肠痈瘀滞证（E对）。